下列不属于非概率抽样的方法是
A. 定额抽样
B. 雪球抽样
C. 整群抽样
D. 方便抽样
E. 立意抽样

正确答案：C。整群抽样